糖皮质激素对血液系统的影响是
A. 中性粒细胞的数量增加
B. 中性粒细胞的数量减少
C. 红细胞的数量减少
D. 血小板的数量减少
E. 红细胞数和Hb均减少

正确答案：A。中性粒细胞的数量增加

解析：糖皮质激素能刺激骨髓造血功能，使红细胞和血红蛋白含量增加，大剂量可使血小板增多；使中性粒细胞数增多，但却降低其游走、吞噬、消化及糖酵解等功能，因而减弱对炎症区的浸润与吞噬活动。可使血液中淋巴细胞减少。掌握“糖皮质激素”知识点。